《纽伦堡法典》属于
A. 规范器官移植的国际文献
B. 体现我国唐代大医学家孙思邈的医德思想的医德文献
C. 体现古希腊医学家希波克拉底的医德思想的医德文献
D. 作为国际上进行基因疗法行为规范的文件
E. 规范人体试验行为的国际文件

正确答案：E。规范人体试验行为的国际文件

解析：本题考查人体试验的伦理原则。《纽伦堡法典》属于规范人体试验行为的国际文件。规范器官移植（A错）的国际文献是《伊斯坦布尔宣言》。体现我国唐代大医学家孙思邈的医德思想的医德文献（B错）是《大医精诚》。体现古希腊医学家希波克拉底的医德思想的医德文献（C错）是《希波克拉底誓言》。作为国际上进行基因疗法行为规范的文件（D错）是《世界人类基因组与人权宣言》。